哮喘与肺炎喘嗽的主要区别是
A. 咳嗽气喘
B. 痰壅
C. 气急
D. 鼻煽
E. 哮鸣，呼气延长

正确答案：E。哮鸣，呼气延长

解析：哮喘为宿痰伏肺，遇感而发，而肺炎喘嗽多为感受外邪所致，肺炎喘嗽的病因，可成为哮喘发作的外因，因此肺炎喘嗽症状均可在哮喘发作时见到，如咳嗽气喘、痰壅、气急、鼻煽等，而哮鸣、呼气延长为哮喘的独特症状，在肺炎喘嗽中不可见，可作为鉴别的特殊症状（ABCD错）（E对）。